能促进气血循环，消除炎性水肿的是
A. 疏密波
B. 断续波
C. 锯齿波
D. 密波
E. 疏波

正确答案：A。疏密波

解析：疏密波是疏波、密波交替出现的一种波型，疏、密波交替持续的时间各约1.5秒。疏密波能克服单一波型易产生耐受现象的缺点，刺激作用较大，治疗时兴奋效应占优势，能引起肌肉有节奏的收缩，刺激各类镇痛介质的释放，促进血液循环和淋巴循环，增强组织的营养代谢，消除炎性水肿等（A对），常用于各种痛症、软组织损伤、关节周围炎、腰背筋膜劳损、面瘫、肌无力、针刺麻醉、局部冻伤等。连续波由基本脉冲波简单重复，中间没有停顿，频率连续可调，每分钟几十次至每秒钟几百次不等。一般频率低于30Hz的连续波叫疏波，频率高于30Hz的叫密波，可用频率旋钮选择疏波或密波。密波易抑制感觉神经和运动神经，常用于止痛、镇静、缓解肌肉和血管痉挛等（D错）；疏波短时兴奋肌肉，提高肌肉韧带的张力，调节血管的舒缩功能，改善血液循环，促进神经肌肉功能的恢复，长时间使用则抑制感觉神经和运动神经，常用于治疗瘫痪、慢性疼痛以及各种肌肉、关节、韧带、肌胞的损伤等（E错）。断续波是节律性时断时续的一种波型。断时，在1.5秒时间内无脉冲电输出；续时，密波连续工作1.5秒。该波型不易使机体产生耐受，对神经肌肉的兴奋作用较疏密波和连续波更强，对横纹肌有良好的刺激收缩作用，常用于治疗痿证、瘫痪等（B错）。